因部分肺泡通气V/血流比例大于0.8而发生呼吸衰竭可见于
A. 肺不张
B. 肺水肿
C. 肺动脉栓塞
D. 慢性阻塞性肺病患者
E. 支气管肺炎

正确答案：C。肺动脉栓塞

解析：因部分肺泡通气V/血流比例大于0.8而发生呼吸衰竭可见于肺动脉栓塞（C对）。